原发性再障的病因是
A. 化学物质
B. 医用药物
C. 放射线
D. 病毒感染
E. 以上均非

正确答案：E。以上均非

解析：原发性再生障碍性贫血是指无明显诱因的再生障碍性贫血，故原发性再障无明显病因（E对）。化学物质（A错）、医用药物（B错）、放射线（C错）及病毒感染（D错）均为继发性再障的可能病因。